恙虫病的的传播媒介是
A. 蜱
B. 人虱
C. 吸虫
D. 恙螨
E. 鼠蚤和鼠虱

正确答案：D。恙螨

解析：恙虫病传播媒介是恙螨。掌握“立克次氏体”知识点。